分布于下唇以下皮肤的神经是
A. 下牙槽神经
B. 面神经下颌缘支
C. 颏神经
D. 颊神经
E. 面神经颊支

正确答案：C。颏神经

解析：分布于下唇以下皮肤的神经是颏神经（C对），为感觉性神经。下牙槽神经（A错）在出颏孔移行为颏神经前，感觉纤维分布于下颌牙及牙龈，运动纤维支配下颌舌骨肌及二腹肌前腹。面神经下颌缘支（B错）运动性神经，支配下唇诸肌。颊神经（D错）为感觉性神经，分布于颊部皮肤及口腔侧壁黏膜。面神经颊支（E错）为运动性神经，支配颊肌、口轮匝肌及其他口周围肌。